牙本质龋的病理改变中脂肪变性层属于哪一层结构
A. 死区
B. 透明层
C. 脱矿层
D. 细菌侵入层
E. 坏死崩解层

正确答案：B。透明层

解析：本题考查牙本质龋。牙本质龋的病理改变中脂肪变性层属于透明层（B对）结构。透明层：有时，在细菌侵入之前，部分区域牙本质小管内成牙本质细胞突起在细菌酶的作用下，细胞膜等有机成分发生脂肪变性，光镜下呈云雾状，曾称此区域为脂肪变性层。在脂肪变性的基础上，也可发生矿物盐晶体的沉着，形成透明层。脱矿层（C错），部分小管内成牙本质细胞突起在龋形成的早期阶段变性、坏死，小管内较空虚，内含空气和死亡的成牙本质细胞突起残余，透射光下观察牙本质磨片，此区呈暗黑色不透光，称死区（A错）。细菌侵入层（D错）位于脱矿层表面，牙本质小管内有细菌侵入，细菌甚至进入牙本质小管分支，显微镜下见，细菌侵犯前沿的形态不规则。坏死崩解层（E错）为牙本质龋损的最表层，随着液化坏死灶扩大，数量增多，细菌不再局限于小管内，而侵入管周、管间牙本质，在此区几乎无正常牙本质结构保留，牙本质完全崩解破坏，只残留一些坏死崩解组织和细菌，龋洞开始从釉牙本质界处形成。